心力衰竭的常见诱因是
A. 酸中毒
B. 高钾血症
C. 分娩
D. 肺部感染
E. 以上都是

正确答案：E。以上都是

解析：凡是能增加心脏负荷，使心肌耗氧量增加和（或）供血供氧减少的因素皆可成为心力衰竭的诱因。酸中毒（A对）时，H+与Ca2+竞争性结合肌钙蛋白，使心肌兴奋-收缩耦联过程受阻。高钾血症（B对）通过干扰心肌生理特性使心肌正常功能受损。分娩（C对）时的疼痛及精神紧张可兴奋交感神经系统，使心率增加、外周小血管收缩，加重心脏负荷。肺部感染（D对），致病微生物及产物可直接损伤心肌，另外感染引起的发热兴奋交感神经，增加心率和心肌耗氧量。故E为本题正确答案。